有关栓剂中药物吸收的不正确表述有
A. 局部作用的栓剂，药物通常不需要吸收或应尽量减少吸收
B. 降低弱酸性药物的pH值或升高弱碱性药物的pH值均可增加吸收
C. 在油脂性基质中，加入表面活性剂的量愈多，药物吸收愈多
D. 基质的溶解特性正好与药物相反时，不利于药物的释放与吸收
E. 药物的粒径愈小，表面积愈大，愈有利于药物的吸收

正确答案：C、D。在油脂性基质中，加入表面活性剂的量愈多，药物吸收愈多；基质的溶解特性正好与药物相反时，不利于药物的释放与吸收